临床用于治疗醛固酮升高引起的顽固性水肿的药物是
A. 呋塞米
B. 氢氯噻嗪
C. 阿米洛利
D. 氨苯蝶啶
E. 螺内酯

正确答案：E。螺内酯

解析：本题考查螺内酯的临床作用。临床用于治疗醛固酮升高引起的顽固性水肿的药物是螺内酯（E对）。螺内酯主要用于伴有醛固酮升高的顽固性水肿，如充血性心力衰竭、肝硬化腹水及肾病综合征。呋塞米（A错）为常用的速效利尿剂，主要用于急性肺水肿和脑水肿、急慢性肾衰竭、加速毒物排泄等。氢氯噻嗪（B错）是噻嗪类中效利尿药，主要用于水肿性疾病，高血压等。阿米洛利（C错）临床用于治疗充血性心力衰竭、肝硬化腹水和肾病综合征等水肿性疾病以及肾上腺糖皮质激素治疗过程中发生的水钠潴留。氨苯蝶啶（D错）在临床上用于治疗各种水肿，常与排钾利尿药合用治疗顽固性水肿。